过期妊娠孕妇需迅速终止妊娠的情况是
A. 缩宫素激惹试验阳性
B. 无应激试验反应型
C. 12小时胎动18次
D. 胎儿监护早期减速
E. B超羊水最大暗区垂直深度40mm

正确答案：A。缩宫素激惹试验阳性

解析：缩宫素激惹试验阳性（A对）是指给孕妇使用缩宫剂诱导出宫缩，提示胎盘功能已经减退，胎儿在宫内处于缺氧状态，需迅速终止妊娠，使胎儿尽快脱离母体子宫的不良环境，保证胎儿的安全。无应激实验反应型（B错）为胎心率110～160次/分，需观察或进一步评估病情。胎动＜10次/2h提示胎儿窘迫，相当于12小时得有60次 （C错）仅有轻度缺氧，不需迅速终止妊娠。胎儿监护早期减速（D错）一般发生在第一产程后期，为宫缩时胎头受压引起，不需迅速终止妊娠。B超羊水最大暗区垂直深度40mm（E错）（正常值为30～80mm），属于正常范畴。